蛋白质功效比值是表示蛋白质的
A. 利用率
B. 消化率
C. 蛋白质含量
D. 表观消化率
E. 净利用率

正确答案：A。利用率